影响化学毒物吸收的因素是
A. 药物属性
B. 吸收部位
C. 血流量，吸收面积，接触时间，亲和力
D. 以上都是

正确答案：D。以上都是

解析：本题考查影响化学毒物吸收的因素。影响化学毒物吸收的因素是药物属性、吸收部位、血流量、吸收面积、接触时间、亲和力（D对ABC错）等。